说明以下药物配伍使用的目的：吗啡与阿托品联合使用
A. 利用药物间的拮抗作用，克服药物的毒副作用
B. 产生协同作用，增强药效
C. 减少或延缓耐药性的发生
D. 形成可溶性复合物，有利于吸收
E. 有利于排泄

正确答案：A。利用药物间的拮抗作用，克服药物的毒副作用